眼底散瞳检查宜选用
A. 托吡卡胺滴眼剂
B. 拉坦前列素滴眼剂
C. 氯霉素滴眼液
D. 碘苷滴眼剂
E. 泼尼松龙滴眼剂

正确答案：A。托吡卡胺滴眼剂

解析：本题考查眼科疾病用药。眼底散瞳检查宜选用托吡卡胺（A对）。拉坦前列素（B错）用于治疗青光眼。氯霉素（C错）用于抗眼部细菌感染。碘苷（D错）用于眼部病毒感染。醋酸泼尼松龙滴眼液（E错）适用于短期治疗对类固醇敏感的眼部炎症（排除病毒、真菌和细菌病原体感染）。